当牙齿轻度脱矿时以下哪种结构较明显
A. 釉面横纹
B. 芮氏线
C. 生长线
D. 绞釉
E. 釉牙本质界

正确答案：A。釉面横纹

解析：釉面横纹处矿化度较低，故当牙轻微脱矿时横纹较明显。掌握“牙釉质”知识点。